McCune-Albright综合征X线表现为
A. 呈现为境界明显的密度减低区，有时表现为多房性骨吸收
B. 颌骨膨胀病变部位边缘模糊，不整齐，下颌骨可形成囊肿样腔洞
C. 虫蚀状骨吸收，有局灶性阻射影，伴有骨新生时，则有骨硬化的表现
D. 圆形界限清楚的阻射区，局限于一个或两个牙的根尖区，与牙根容易区分
E. 病变骨区阻射性降低，呈磨玻璃样改变，病变与周围正常骨的界限不明显

正确答案：E。病变骨区阻射性降低，呈磨玻璃样改变，病变与周围正常骨的界限不明显

解析：McCune-Albright综合征发生于颌骨的病变上颌比下颌多见，一般表现为无痛性骨膨胀，引起颜面部不对称，牙移位及咬合关系改变。典型的X线表现为病变骨区阻射性降低，呈磨玻璃样改变，病变与周围正常骨的界限不明显。病变区纤维成分较多时，可表现为囊性密度减低区，类似于囊肿或囊性肿瘤。掌握“结核性骨髓炎及放射性骨髓炎”知识点。